附骨疽病人多见于
A. 婴儿
B. 儿童
C. 少年
D. 青年
E. 老年

正确答案：B。儿童

解析：附骨疽是一种毒气深沉、附着于骨的化脓性疾病。其临床特点是儿童常见（B对），多发于四肢长骨，局部胖肿，附筋着骨，推之不移，疼痛彻骨，溃后脓水淋漓，不易收口，可形成窦道，损伤筋骨。生于大腿外侧者称附骨疽；生于大腿内侧者谓咬骨疽；生于股胫部的称股胫疽等。